痄腮发病率最高的年龄阶段是
A. 新生儿期
B. 婴儿期
C. 幼儿期
D. 幼童期
E. 儿童期

正确答案：E。儿童期

解析：痄腮好发于三岁以上的儿童，而儿童期，五版教材指7周岁-12周岁，亦称为学龄期，此时期的小儿患疾病种类及表现已和成人类似（E对）。新生儿期为出生后脐带结扎开始，至出生后满28天，尤需注重皮肤黏膜、呼吸道、脐部等的护理（A错）。婴儿期为出生后28天至一周岁，易患肺系疾病，脾系疾病及各种传染病（B错）。幼儿期为一周岁至三周岁，易发生意外事故（C错）。幼童期为三周岁至七周岁，儿童容易发生溺水、烫伤、坠床、错服药物以致中毒等事件（D错）。